有利于弱碱性药物（如生物碱等）从尿液中排出的是
A. 地西泮
B. 丙磺舒
C. 氯化钙
D. 氯化铵
E. 氨茶碱

正确答案：D。氯化铵

解析：本题考查氯化铵。有利于弱碱性药物（如生物碱等）从尿液中排出的是氯化铵（D对）。氯化铵适应证：①干咳以及痰不易咳出等。②酸化尿液。③纠正代谢性碱中毒。地西泮（A错）、丙磺舒（B错）、氯化钙（C错）均显酸性。氨茶碱（E错）为茶碱类平喘药，用于支气管哮喘、喘息性支气管炎、阻塞性肺气肿等，缓解喘息症状；也可用于心源性肺水肿引起的哮喘。